下列哪项不是机械性肠梗阻的原因
A. 肿瘤
B. 嵌顿疝
C. 粪块阻塞
D. 粘连带压迫
E. 弥漫性腹膜炎

正确答案：E。弥漫性腹膜炎

解析：肠梗阻(1) 梗阻原因分类 可分为机械性、动力性、血运性肠梗阻 机械性肠梗阻 : 系机械性因素引起肠腔狭小或不通，致使场内容物不能通过 临床上常见） 肠外因素——如粘连带压迫、嵌顿、肿瘤压迫 肠壁因素——如肠套叠、炎症性狭窄、肿瘤、先天性畸形 肠腔内因素——如蛔虫梗阻、异物、粪块、胆石堵塞等 动力性肠梗阻 : 是由于神经抑制或毒素刺激，以致肠壁肌运动紊乱，但无器质性肠腔狭小 麻痹性肠梗阻 : 多发生在腹腔手术后、腹部创伤弥漫性腹膜炎低钾血症 痉挛性肠梗阻 : 可见于急性肠炎、肠功能紊乱、慢性铅中毒 血运性肠梗阻 : 由于肠系膜血管栓塞或血栓形成，使肠管血运障碍，肠管失去蠕动能力 肠腔虽无阻塞，但肠内容物停止运行 肠梗阻(2) 低位肠梗阻，因梗阻位置较低，呕吐发生较晚，梗阻位置以上的肠管较多，因此扩张的范围较广，可出现显著的腹胀，腹部高度膨胀，且其肠内容物经发酵呈粪样，因此呕吐物后期为粪样内容物。 高位肠梗阻，较显著的特点是呕吐发生较早、较频繁，呕吐物常为胃及十二指肠内容物，且腹胀不明显。 痉挛性肠梗阻，相对比较少见，可发生于急性肠炎、慢性铅中毒或肠功能紊乱的病人。 麻痹性肠梗阻，腹胀较显著，因为其肠壁肌呈瘫痪状态因此无收缩即无阵发性腹痛，只有持续性胀痛或不适，肠鸣音可减弱或消失，其呕吐常为溢出性。 绞窄性肠梗阻，为伴有相应肠段血运障碍的肠梗阻，其特点常为持续性的剧烈腹痛，可有腹膜刺激征阳性及粘液脓血便，若呕吐物呈棕褐色或血性，应考虑肠管血运障碍。 肠梗阻(3) 绞窄肠梗阻——持腹痛+血便+腹膜征+无肠音 麻痹肠梗阻——持腹胀+无腹痛+无肠音。弥漫性腹膜炎、腹部创伤等是引起麻痹性肠梗阻的常见原因（E错，为本题正确答案）。机械性肠梗阻指由于机械性因素引起肠腔狭小或不通，使肠内容物不能通过所致的肠梗阻，其常见原因包括：①肠外因素，如肿瘤压迫（A对）、嵌顿疝（B对）、粘连带压迫（D对）等；②肠壁因素，如肠套叠、肠扭转、肿瘤、先天性畸形等；③肠腔内因素，如蛔虫梗阻、异物、粪块堵塞（C对）等。